下列色谱法术语中，可用于样品组分定性的色谱参数是
A. 保留时间
B. 调整保留时间
C. 相对保留值
D. 峰高
E. 峰面积

正确答案：A、B、C。保留时间；调整保留时间；相对保留值

解析：本题考查色谱法。下列色谱法术语中，可用于样品组分定性的色谱参数是保留时间（A对）、调整保留时间（B对）、相对保留值（C对）。保留时间是色谱法的基本定性参数，主要用于定距洗脱。调整保留时间仅决定于组分的性质，因此调整保留时间是定性的基本参数。两组分的调整保留值之比称为相对保留值，又称选择性因子，用于定性。峰高（D错）和峰面积（E错）是定量的基本参数。